唾液腺肿瘤中最常见的是
A. 沃辛瘤
B. 黏液囊性瘤
C. 腺样囊性瘤
D. 多形性腺瘤
E. 黏液表皮样瘤

正确答案：D。多形性腺瘤

解析：多形性腺瘤又名混合瘤，是唾液腺肿瘤中最常见者。掌握“多形性腺瘤”知识点。